紫外光谱中峰带Ⅱ吸收在250左右的是
A. 黄酮
B. 5-羟基黄酮
C. 5，6，7-三羟基黄酮
D. 黄烷
E. 5-羟基黄烷

正确答案：A。黄酮

解析：本题考查的是黄酮类化合物的UV光谱。紫外光谱中峰带Ⅱ吸收在250左右的是黄酮（A对）。黄酮和黄酮醇类化合物的UV光谱图形相似，共同特征是均出现两个主峰，且峰形相似、强度相近。带Ⅱ的峰位主要受A环含氧取代程度的影响，当A环上的含氧取代基增加时，带Ⅱ红移，但对带Ⅰ无影响或影响甚微（5-羟基除外）。化合物：黄酮，A环上羟基位置：无，带Ⅱ：250nm。化合物：5-羟基黄酮（B错），A环上羟基位置：5，带Ⅱ：268nm。化合物：5，6，7-三羟基黄酮（C错），A环上羟基位置：5，6，7，带Ⅱ：274nm。